牙龈指数记分为2的是
A. 晚期牙周病，牙周袋深度6mm或以上
B. 牙龈中等炎症，色红，光亮水肿，探诊出血
C. 牙龈有颜色改变，明显肿胀，探诊出血或自动出血
D. 早期牙周病，牙周袋深度4~5mm
E. 牙龈轻度炎症，牙龈颜色有轻度改变并轻度水肿

正确答案：B。牙龈中等炎症，色红，光亮水肿，探诊出血

解析：本题考查牙龈指数的记分标准。牙龈指数记分为2的是牙龈中等炎症，色红，光亮水肿，探诊出血（B对）。牙龈指数的记分标准：①0=牙龈正常；②1=牙龈轻度炎症：牙龈颜色有轻度改变并轻度水肿，探诊不出血；③2=牙龈中等炎症：牙龈色红，水肿光亮，探诊出血；④3=牙龈严重炎症：牙龈明显红肿或有溃疡，有自动出血倾向。